金钱草不具有的功效是
A. 利尿通淋
B. 通经下乳
C. 除湿退黄
D. 解毒消肿
E. 排除结石

正确答案：B。通经下乳

解析：本题考查的是金钱草的性能特点。金钱草不具有的功效是通经下乳（B错，为本题正确答案）。金钱草：【性味归经】甘、咸，微寒。归肝、胆、肾、膀胱经。【性能特点】本品甘淡渗利，咸软入肾，微寒能清。入肝、胆经，清利肝胆而退黄（C对）、排石；入肾与膀胱经，清热利尿而善通淋（A对）、排石（E对）；还能清热解毒而消肿（D对）疗疮。为治湿热黄疸、肝胆结石、石淋之佳品。还能清热解毒而消肿，为治疮肿、蛇伤所常用。通经下乳为木通的功效。木通：【功效】利水通淋，泄热，通经下乳。